五体中与肺相合的是
A. 脉
B. 皮
C. 肉
D. 筋
E. 骨

正确答案：B。皮

解析：本题考查五脏与五体的关系。肺在体合皮，她们依赖于卫气和津液的温养和润泽，具有防御外邪，调节津液代谢，调节体温和辅助呼吸的作用（B对）。心在体合脉（A错），脾在体合肉（C错），肝在体合筋（D错），肾在体合骨（E错）。